男，65岁。既往有胆石病病史10年，突发右肝区绞痛，伴右肩区疼痛。右肩区疼痛的性质是
A. 牵涉痛
B. 躯体痛
C. 痉挛性痛
D. 体腔壁痛
E. 扩散性疼痛

正确答案：A。牵涉痛

解析：腹痛依据接受痛觉的神经分为内脏神经痛、躯体神经痛和牵涉痛。内脏神经主要感受胃肠道膨胀等机械和化学刺激，通常腹痛定位模糊，范围大，不准确。躯体神经属于体神经，主要感受壁层和脏腹膜的刺激，定位清楚、腹痛点聚焦准确，如胆石病突发右肝区绞痛。牵涉痛也称放射痛，是腹痛时牵涉到远处部位的疼痛，如肩部，这是因为两者的痛觉传入同一神经根（A对）。